发现心包积液最简便准确的方法是
A. 心电图
B. 超声心动图
C. 冠状动脉造影
D. 核素心肌显像
E. 心包穿刺

正确答案：B。超声心动图

解析：发现心包积液最简便准确的方法是超声心动图（B对），若发现心前壁前和心后壁后有液性暗区，即可确诊心包积液。心电图（A错）主要用于心律失常、心肌梗死等疾病的诊断，心包积液时虽可见P波、QRS波、T波电交替，但并无诊断特异性。冠状动脉造影（P222）（C错）为有创性检查手段，目前主要用于冠心病的确诊。核素心肌显像（P222）（D错）为放射性核素检查的一种，可显示心肌梗死的部位和范围。心包穿刺（E错）主要目的为迅速缓解心脏压塞，同时可以对心包积液进行相关检查，以明确病因。